细胞内液绝大部分存在于
A. 心肌中
B. 骨骼肌中
C. 平滑肌中
D. 泌尿系统中
E. 消化系统中

正确答案：B。骨骼肌中

解析：体液包括细胞内液和细胞外液两大部分。细胞内液绝大部分存在于骨骼肌中，男性约占体重的40%，女性的肌肉不如男性发达，故女性的细胞内液约为体重的35%，所以细胞内液绝大部分存在于骨骼肌中（B对）。